传染性非典型肺炎的主要传播途径是
A. 水
B. 体液
C. 飞沫
D. 土壤
E. 血制品

正确答案：C。飞沫

解析：传染性非典型肺炎的主要传播途径为飞沫传播（C对）。通过水（A错）传播的传染病有霍乱、钩端螺旋体病等。通过体液（B错）、血制品传播（E错）的传染病包括艾滋病、乙型肝炎、丙型肝炎、丁型肝炎、淋病等。通过土壤（D错）传播的传染病为炭疽等。